下列方剂中不是黄芩、黄连同用的是
A. 半夏泻心汤
B. 普济消毒饮
C. 当归六黄汤
D. 黄连解毒汤
E. 龙胆泻肝汤

正确答案：E。龙胆泻肝汤

解析：龙胆泻肝汤含有龙胆草、黄芩、栀子、泽泻、木通、当归、生地黄、柴胡、生甘草、车前子，可清泻肝胆实火，清利肝经湿热（E错，为本题正确答案）。半夏泻心汤含有半夏、黄连、黄芩、干姜、甘草、大枣、人参（A对）。普济消毒饮含有黄芩、黄连、陈皮、生甘草、玄参、柴胡、桔梗、连翘、板蓝根、马勃、牛蒡子、薄荷、僵蚕、升麻（B对）。当归六黄汤含有当归、生地黄、黄芩、黄柏、黄连、熟地黄、黄芪（C对）。黄连解毒汤含有黄连、黄芩、黄柏、栀子（D对）。龙胆泻肝栀芩柴，生地车前泽泻偕，木通甘草当归合，肝经湿热力能排。